盐酸一镁粉反应呈粉红色，加热后变为玫瑰红色，与三氯化铁反应呈草绿色的是
A. 黄芩苷
B. 木樨草素
C. 大豆素
D. 杜鹃素
E. 金丝桃苷

正确答案：D。杜鹃素